某社区为地方性氟中毒流行区，一般认为氟骨症多见的年龄段为
A. 幼儿
B. 学龄期儿童
C. 青壮年
D. 新迁入的老年人
E. 新迁入的成年人

正确答案：C。青壮年

解析：氟骨症发病主要在成年人，多发于青壮年，发病率随着年龄增长而升高，在病区居住年限越长，氟骨症患病率越高，病情越重（C对）。